治疗水肿湿毒浸淫证，应首选
A. 越婢加术汤
B. 麻黄连翘赤小豆汤合五味消毒饮
C. 五皮饮合胃苓汤
D. 实脾饮
E. 疏凿饮子

正确答案：B。麻黄连翘赤小豆汤合五味消毒饮

解析：麻黄连翘赤小豆汤宣肺利尿，治风水在表之水肿；五味消毒饮清热解毒，治疮毒内归